胃溶性的薄膜衣材料是
A. 丙烯酸树脂Ⅱ号
B. 丙烯酸树脂Ⅲ号
C. Eudragits L型
D. HPMCP
E. HPMC

正确答案：E。HPMC

解析：本题考查片剂的包衣。羟丙甲纤维素（HPMC）（E对）属于胃溶型包衣材料；丙烯酸树脂Ⅱ号（A错）、丙烯酸树脂Ⅲ号（B错）、HPMCP（D错）即羟丙甲纤维素酞酸酯均为肠溶型包衣材料。